下列哪项是牙髓坏死与可复性牙髓炎的鉴别要点
A. 叩诊不适
B. 牙髓温度测验反应不同
C. 牙龈无瘘管
D. X线片显示根尖周正常
E. X线片显示髓腔影像正常

正确答案：B。牙髓温度测验反应不同

解析：可复性牙髓炎温度测验有一过性敏感，而牙髓坏死则无反应。掌握“牙髓坏死、牙髓钙化与牙内吸收”知识点。